根据《中华人民共和国药品管理法》，用于直接包装药品制剂的铝箔，必须符合
A. 药品标准
B. 企业标准
C. 行业标准
D. 药用要求
E. 卫生要求

正确答案：D。药用要求

解析：本题考查药品制剂的包装。根据《中华人民共和国药品管理法》，用于直接包装药品制剂的铝箔，必须符合药用要求（D对）。